下列关于口腔颌面部淋巴结的检查叙述中，不恰当的是
A. 检查时患者取坐位，头稍低，略偏向非检查侧
B. 检查应按一定顺序，由浅入深，滑动触诊
C. 检查时患者取坐位，检查者应站在其右方
D. 可检查淋巴结所在的部位、大小、数目、硬度等
E. 检查的一般的顺序为枕部、耳后、耳前、腮腺、颊、颌下、颏下

正确答案：A。检查时患者取坐位，头稍低，略偏向非检查侧

解析：检查颌面、颈部淋巴结，对口腔颌面部炎症及肿瘤患者的诊断和治疗具有重要意义。检查时患者取坐位，检查者应站在其右方（前或后），患者头稍低，略偏向检查侧，以使皮肤、肌肉松弛便于触诊。检查者手指紧贴检查部位，按一定顺序，由浅入深，滑动触诊。一般的顺序为：枕部、耳后、耳前、腮腺、颊、颌下、颏下；顺胸锁乳突肌前后缘、颈前后三角、直至锁骨上凹，仔细检查颈深、浅淋巴结，颈部淋巴结的所在部位和引流方向。触诊检查淋巴结时应注意肿大淋巴结所在的部位、大小、数目、硬度、活动度、有无压痛或波动感及与皮肤或基底部有无粘连等情况。掌握“口外一般检查及辅助检查”知识点。